为满足临床需要，许多药物往往存在多种剂型，通常认为它们在胃肠道中的吸收顺序是
A. 混悬剂>溶液剂>胶囊剂>普通片剂>包衣片
B. 溶液剂>混悬剂>胶囊剂>普通片剂>包衣片
C. 胶囊剂>混悬剂>溶液剂>普通片剂>包衣片
D. 普通片>包衣片>胶囊剂>混悬剂>溶液剂
E. 混悬剂>溶液剂>胶囊剂>包衣片>普通片剂

正确答案：B。溶液剂>混悬剂>胶囊剂>普通片剂>包衣片

解析：本题考查剂型对药物吸收的影响。为满足临床需要，许多药物往往存在多种剂型，通常认为它们在胃肠道中的吸收顺序是溶液剂>混悬剂>胶囊剂>普通片剂>包衣片（B对）。口服溶液剂不存在药物释放问题，吸收最快；混悬剂分散度大，药物释放迅速；胶囊剂外壳崩解后药粉相当于散剂；包衣片相对于片剂要先溶解衣层，故吸收速度慢于片剂。